患者肢体关节疼痛，痛势较剧，部位固定，遇寒加重，得热痛缓，局部皮肤有寒凉感。舌淡苔白，脉弦紧。治疗应首选
A. 防风汤
B. 乌头汤
C. 薏苡仁汤
D. 双合汤
E. 补血荣筋丸

正确答案：B。乌头汤

解析：防风汤为行痹的选方，功能发散风寒，祛湿通络（A错）。题中患者以肢体关节疼痛为主症，故诊断为痹证，肢体关节疼痛，痛势较剧，部位固定是由于寒性凝滞，主收引，寒邪流于经络，痹阻气血所致，遇寒则血愈凝涩，故遇寒加重，得热则寒邪祛散，气血运行较为流畅，故得热痛缓，寒为阴邪，故局部皮肤有寒凉感，舌淡苔白，脉弦紧为寒湿之象，故辨为痛痹，治宜散寒通络，祛风除湿，方选乌头汤（B对）。薏苡仁汤为着痹的选方，功能健脾祛湿，发散风寒（C错）。双合汤为痹证痰瘀痹阻证的选方，功能活血化瘀，祛痰通络（D错）。补血荣筋丸功能滋阴补血，强筋健骨，多用于治疗痿证（E错）。